男性，29岁。转移性右下腹痛伴发热36小时入院，诊断为急性阑尾炎。入院后腹痛加重，伴有寒战，体温40度，巩膜轻度黄染，剑突下压痛，右下腹肌紧张，右下腹明显压痛反跳痛。最可能的诊断是
A. 急性阑尾穿孔
B. 阑尾炎合并胃穿孔
C. 腹膜炎引起溶血性黄疸
D. 门静脉炎
E. 阑尾与结肠形成内瘘

正确答案：D。门静脉炎

解析：青年男性患者，以急性阑尾炎入院，入院后腹痛加重，伴寒战、高热，巩膜轻度黄染，剑突下压痛（提示门静脉炎），结合患者病史、体查，最可能的诊断为化脓性门静脉炎（D对）。急性阑尾炎时，阑尾静脉中的感染性血栓可沿肠系膜静脉回流至门静脉，细菌在此处生长、繁殖，可引起化脓性门静脉炎，严重者可出现细菌性肝脓肿。急性阑尾炎穿孔（A错）因阑尾腔压力骤减，腹痛可暂时减轻，但出现腹膜炎后，腹痛会持续性加剧并且范围扩大。胃穿孔（B错）常见于胃溃疡的患者，多表现为突发的上腹部刀割样疼痛，全腹压痛、反跳痛，腹肌紧张，叩诊肝浊音界缩小或消失，无巩膜黄染等表现。溶血性黄疸（C错）主要表现为腰背部及四肢酸痛，伴头痛、呕吐、寒战，有不同程度的贫血和血红蛋白尿。阑尾与结肠形成内瘘（E错）多无明显临床表现。